脏腑关系中，“水火既济”指的是
A. 肝与肾
B. 心与肾
C. 肝与脾
D. 肺与脾
E. 肺与肝

正确答案：B。心与肾

解析：心与肾，心火在上必须下行至肾，资助肾阳以温肾水，使肾水不寒，肾水在下必须上行至心，资助心阴以涵养心阳，使心火不亢，从而维持心肾乃至全身的水火阴阳之间的协调平衡，这种关系称之为“心肾相交”、“水火既济”（B对）。肝肾、肝脾、肺脾、肺肝在五行上不符水火的属性（ACDE错）。